食积胃痛常见的症状有
A. 胃脘胀痛
B. 嗳腐恶食
C. 喜按喜温
D. 大便色黑
E. 呕吐清水

正确答案：A、B。胃脘胀痛；嗳腐恶食

解析：本题考查的是胃痛的辨证论治。食积胃痛常见的症状有胃脘疼痛（A对）与嗳腐恶食（B对）。食积胃痛指胃痛饮食伤胃证。胃痛饮食伤胃证：【症状】胃脘疼痛，胀满拒按，嗳腐恶食，或吐不消化食物，吐后或矢气后痛减，大便不爽。舌淡红，苔厚腻，脉滑。喜按喜温（C错）与呕吐清水（E错）为胃痛脾胃虚寒证的症状。胃痛脾胃虚寒证：【症状】胃痛隐隐，绵绵不休，喜温喜按，空腹痛甚，得食痛缓，劳累或受凉后发作或加重，时呕清水，神疲纳少，四肢倦怠，手足不温，大便溏薄。舌淡苔白，脉虚弱或迟缓。大便色黑（D错）为瘀阻胃肠的症状。瘀阻胃肠，可见呕血、大便色黑如漆。